男，60岁。体检发现血钙2.9mmol/L，进—步检查发现PTH及尿钙升高，血磷0.5mmol/L。为明确诊断，最具特异性的辅助检查是
A. 胸部B超
B. 颈部X射线
C. 颈部99mTcMIBI
D. 颈部CT
E. 颈部MRI

正确答案：C。颈部99mTcMIBI

解析：患者老年男性，实验室检查示血钙2.9mmol/L（升高，正常值2.25～2.75mmol/L），PTH及尿钙升高，血磷0.5mmol/L（降低，正常值1.1～1.3mmol/L），易诊断为甲状旁腺功能亢进症。颈部99mTcMIBI（C对）是将放射性药物注入体内后测定其放射性变化，既可以确定病变部位，又能检测甲状旁腺功能，因此是最具特异性的辅助检查。